薏苡仁的功效是
A. 利水渗湿，健脾止泻
B. 利水渗湿，养心安神
C. 清热利湿，利胆退黄
D. 利尿通淋，行气止痛
E. 利水通淋，通经下乳

正确答案：A。利水渗湿，健脾止泻

解析：本题考查的是薏苡仁的功效。薏苡仁的功效是利水渗湿，健脾止泻（A对）。薏苡仁：【功效】利水渗湿，健脾止泻，除痹，清热排脓。茵陈：【功效】清热利湿，退黄（C错）。木通：【功效】利水通淋，泄热，通经下乳（E错）。功效为利水渗湿，养心安神（B错）或利尿通淋，行气止痛（D错）的中药，2022年考试指南未明确说明。